用于阴虚外感,养阴而不恋邪的药物是
A. 生地黄
B. 石斛
C. 玉竹
D. 青蒿
E. 丹皮

正确答案：C。玉竹

解析：玉竹的功效是养阴润燥，生津止渴，其应用是肺阴虚证 又因本品滋阴而不碍邪，与疏散风热之薄荷、淡豆豉等同用，治阴虚之体感受风温及冬温咳嗽，咽干痰结等症，可使发汗而不伤阴，滋阴而不留邪，如加减葳蕤汤（C对）。